患者，男，42岁，因非小细胞肺癌使用铂类药物化疗，同时给予止吐药物、升白细胞药物和水化治疗。关于该患者使用这种药物的说法，错误的是
A. 若出现了严重骨髓抑制，应停用铂类化疗药物
B. 治疗期间每周应复查全血细胞计数
C. 化疗期间应严格避孕
D. 在铂类药物中，顺铂引起的恶心、呕吐最为严重
E. 化疗期间和化疗后，应限制饮水量

正确答案：E。化疗期间和化疗后，应限制饮水量

解析：本题考查化疗注意事项。在化疗期间与化疗后，患者必需饮用足够的水分（E错，为本题正确答案）。